具有抗厌氧菌作用的药物有
A. 氨曲南
B. 舒巴坦
C. 头孢拉定
D. 亚胺培南
E. 甲硝唑

正确答案：D、E。亚胺培南；甲硝唑

解析：本题考查抗厌氧菌作用的药物。具有抗厌氧菌作用的药物有亚胺培南（D对）、甲硝唑（E对）。头孢拉定（C错）主要作用于需氧的革兰氏阳性菌。氨曲南（A错）为单酰胺菌素类抗菌药，通过与敏感需氧革兰氏阴性菌膜上的PBP3靶点结合发挥杀菌作用，抗菌谱较窄，对革兰氏阳性菌和厌氧菌作用差。舒巴坦（B错）为常用的β-内酰胺酶抑制剂，单独无效，常与其它β-内酰胺类联合使用。